痛惊宁的通用名是
A. 卡马西平
B. 奥美拉唑
C. 硝苯地平
D. 非洛地平
E. 对乙酰氨基酚

正确答案：A。卡马西平